女性，48岁。右下第一磨牙残冠，邻牙未见松动，建议拔除后义齿修复。拔除时需麻醉哪些神经
A. 下牙槽神经、舌下神经和颏神经
B. 舌神经、颊神经和颏神经
C. 下牙槽神经、舌下神经和颊神经
D. 舌神经、舌下神经和颏神经
E. 颊神经、舌神经和下牙槽神经

正确答案：E。颊神经、舌神经和下牙槽神经

解析：下牙槽神经支配下颌牙齿及其牙周膜，舌神经支配下颌牙齿的舌侧牙龈，颏神经支配下颌前牙的唇侧牙龈，颊神经支配下颌后牙的颊侧牙龈。因此在拔除下颌第一磨牙时，下牙槽神经、舌神经、颊神经必须麻醉。掌握“三叉神经的分支与分布”知识点。